对牙周炎的描述正确的是
A. 牙周炎呈缓慢、渐进性破坏
B. 所有人的牙周破坏速度是一样的
C. 牙周组织的破坏程度与菌斑等局部刺激因素永远一致
D. 牙周炎病变呈现静止期和活动期交替出现
E. 牙周炎发病过程中只有破坏没有修复

正确答案：D。牙周炎病变呈现静止期和活动期交替出现

解析：本题考查牙周炎。对牙周炎的描述正确的是牙周炎病变呈静止期和加重期交替出现（D对）。静止期的特征是炎症反应轻，没有或很少有骨和结缔组织的附着丧失，当以G⁺厌氧菌为主构成的非附着菌斑增厚，则开始了骨和结缔组织附培丧失，以及牙周袋加深的加重期，即活动期，可持续数天、数月或数年。此后，常可自动进入静止期。